孕期铁的需要增加是由于
A. 胎儿胎盘发育的需要
B. 胎儿肝脏储存铁供出生后动用
C. 母体红细胞增加的需要
D. 补偿铁的丢失
E. 以上皆是

正确答案：E。以上皆是